属于癌前病变的外阴白色病变是
A. 增生型营养不良
B. 硬化苔癣型营养不良
C. 混合型营养不良
D. 营养不良伴有上皮不典型增生
E. 白癫风

正确答案：D。营养不良伴有上皮不典型增生

解析：外阴白色病变，是由鳞状上皮增生和外阴硬化性苔藓引起的外阴皮肤和黏膜的色素减退。外阴上皮非瘤样病变是一组女性外阴皮肤和黏膜组织发生色素改变和变性的常见慢性病变，其包括外阴鳞状上皮增生（增生型营养不良）（A错）、外阴硬化性苔藓（硬化苔癣型营养不良）（B错）和其它外阴皮肤病，其中有外阴硬化性苔藓合并鳞状上皮增生（混合型营养不良）（C错）、外阴白癜风（E错）、继发性外阴色素减退疾病和贝赫切特病。营养不良伴有上皮不典型增生（D对）是癌前病变的形态学表现。